有关行政机关对法人可以当场作出行政处罚决定的是
A. 五十元以下罚款
B. 五十元以上罚款
C. 一千元以上罚款
D. 三千元以下罚款
E. 二千元以下罚款

正确答案：D。三千元以下罚款

解析：本题考查当场处罚程序。有关行政机关对法人可以当场作出行政处罚决定的是三千元以下罚款（D对）。当违法事实清楚、有法定依据、拟作出数额较小的罚款（对公民处200元以下（A错），对法人或者其他组织处3000元以下的罚款）或者警告时，可以适用简易程序，当场处罚。